可引起嗜酸性粒细胞增多的药物是
A. 氯苯那敏
B. 碳酸氢钠
C. 坎地沙坦
D. 头孢氨苄
E. 地塞米松

正确答案：D。头孢氨苄

解析：本题考查引起嗜酸性粒细胞增多的药物。头孢氨苄（D对）是能够导致嗜酸性粒细胞增多的药物，能导致嗜酸性粒细胞增多的药物还有头孢拉定、头孢呋辛、头孢哌酮等抗生素。长期应用肾上腺皮质激素、坎地沙坦（C错）、甲基多巴等会引起嗜酸性粒细胞减少。氯苯那敏（A错）可抑制神经元对儿茶酚胺的摄取，使受体附近游离儿茶酚胺量增加，因而增加升压反应。碳酸氢钠（B错）会使尿液pH增高。地塞米松（E错）属于肾上腺糖皮质激素，可使血液中嗜酸性细胞及淋巴细胞减少。